仅适用于下颌磨牙的根分叉病变的治疗方法的是
A. 截根术
B. 引导性组织再生术
C. 分根术
D. 翻瓣术
E. 根面平整术

正确答案：C。分根术

解析：分根术仅适用于下颌磨牙。是将下颌磨牙连冠带根从正中沿颊舌方向截开，使其分离为近中、远中两半，形成两个独立的类似单根牙的牙体。掌握“根分叉病变”知识点。